区域环境质量评价不包括
A. 污染源调查评价
B. 环境质量综合评价
C. 环境质量调查评价
D. 环境效应调查评价
E. 环境管理调查评价

正确答案：E。环境管理调查评价

解析：本题考查区域环境质量评价。区域环境质量评价包括污染源调查评价（A对）、环境质量调查评价（C对）和环境效应调查评价（D对），在此基础上做出环境质量综合评价（B对），提出环境污染综合防治方案，为环境污染治理、环境规划制定和环境管理提供参考。以期逐步改善环境质量，达到环境卫生标准或环境质量标准的要求和保障人群健康的目的。环境管理调查评价（E错，为本题正确答案）不属于区域环境质量评价内容。